女，8个月。因发热2天，抽搐2次，伴呕吐，吃奶量减少，喜哭，易怒就诊。母乳喂养。査体：精神差，前囟饱满，心肺腹无异常发现，肌张力增高，脑脊液检查：外观混浊，白细胞1000×10⁶/L，中性粒细胞为主，糖1mmol/L，氯化物107mmol/L，蛋白质2.0g/L。治疗期间，若出现抗利尿激素异常分泌综合征，开始宜选用静脉滴注氯化钠的浓度为
A. 2%
B. 0.9%
C. 0.45%
D. 1.5%
E. 3%

正确答案：E。3%

解析：8个月患儿（化脓性脑膜炎好发年龄），发热2天，抽搐2次（化脓性脑膜炎感染中毒表现），伴呕吐，吃奶量减少，喜哭，易怒。査体：精神差，前囟饱满（化脓性脑膜炎颅内压增高表现），心肺腹无异常发现，肌张力增高（脑膜刺激征阳性），脑脊液检查：外观混浊，白细胞1000×10⁶/L（提示显著增高），中性粒细胞为主，糖1mmol/L（正常值：2.4～4.5mmol/L，提示降低），氯化物107mmol/L（正常值120～130mmol/L，提示降低），蛋白质2.0g/L（0.2～0.45g/L，提示升高）。根据患儿的症状、体查及实验室检查，可诊断为化脓性脑膜炎。治疗期间，若出现抗利尿激素异常分泌综合征，开始宜选用静脉滴注氯化钠的浓度为3%（E对）。抗利尿激素异常分泌综合征可使抗利尿激素分泌增加，导致水潴留，引起低钠血症和血浆低渗透压，可能加剧脑水肿，致惊厥和意识障碍加重，或直接因低钠血症引起惊厥发作。确诊后应用3%盐水6ml/kg缓慢滴注，同时应限制入量来矫正脑性低钠血症。